“心系”是指
A. 心脏
B. 心包
C. 心的功能
D. 心包的功能
E. 心与其他脏器联系的部位

正确答案：E。心与其他脏器联系的部位

解析：本题考查心系的概念，属于理解记忆内容。心系是心与其他脏腑相连的脉络（E对），不是单一的脏腑器官（AB错）。与脏腑功能无关（CD错）。